诊断绞窄性肠梗阻最可靠的依据是
A. 阵发性腹部绞痛
B. 有气过水音和金属音
C. X线检查小肠有多个阶梯状液平
D. 频繁呕吐，呕吐物为胃肠液
E. 腹肌紧张，有压痛和反跳痛

正确答案：E。腹肌紧张，有压痛和反跳痛

解析：绞窄性肠梗阻发病急骤且迅速加重，早期腹痛剧烈，无间歇期，由于肠壁血运障碍，可发生肠坏死、穿孔，引起腹膜炎，出现腹肌紧张，腹部压痛、反跳痛，而单纯性肠梗阻仅有肠内容物通过障碍，无肠管血运障碍，一般无腹膜刺激征。因此，诊断绞窄性肠梗阻最可靠的依据是腹肌紧张，有压痛和反跳痛（E对）。阵发性腹部绞痛（A错）、有气过水声和金属音（B错）多见于单纯性肠梗阻；X线检查小肠有多个阶梯状液平（C错）可提示小肠梗阻，但不能说明已发生绞窄。频繁呕吐，呕吐物为胃肠液（D错）为各种原因引起的肠梗阻的共同表现，若呕吐物出现血性液体，可提示绞窄性肠梗阻。